男，40岁。双下肢水肿1个月。查体：BP150/100mmHg，尿红细胞3～5/HP，尿蛋白5g/d，血白蛋白20g/L，血肌酐70umol/L。近3天腰痛，尿量减少。复查尿常规尿红细胞30～50/HP。B超示右肾增大。血尿加重最可能的原因是
A. 急性过敏性间质肾炎
B. 肾静脉血栓形成
C. 合并泌尿系统肿瘤
D. 进展为新月体肾炎
E. 尿路感染

正确答案：B。肾静脉血栓形成

解析：患者中年男性，双下肢水肿1个月，查体示2级高血压，实验室检查提示大量蛋白尿（尿蛋白定量5g/d，尿蛋白定量＞3.5g/d即为大量蛋白尿），低白蛋白血症（血白蛋白20g/L，血白蛋白＜30/L即为低白蛋白血症），以及血尿，考虑患者肾病综合征可能性大。肾病综合征常见肾静脉栓塞，患者近3天腰痛，尿量减少，血尿加重，右肾增大，最可能的原因是肾静脉血栓形成（B对）。急性过敏性间质肾炎（A错）会有过敏原接触史。肾病综合征不会进展为新月体肾炎（D错）。合并泌尿系统肿瘤（C错）时B超可显示肿瘤。尿路感染（E错）会有膀胱刺激征或发热等全身感染症状，故可排除。